医疗卫生服务体系坚持
A. 以非营利性医疗卫生机构为主体、营利性医疗卫生机构为补充
B. 以营利性医疗卫生机构为主体、非营利性医疗卫生机构为补充
C. 全部为非营利性医疗卫生机构
D. 全部为营利性医疗卫生机构
E. 非营利性医疗卫生机构与营利性医疗卫生机构并存

正确答案：A。以非营利性医疗卫生机构为主体、营利性医疗卫生机构为补充